第三产程中，子宫不协调性收缩可造成
A. 胎盘滞留
B. 胎盘粘连
C. 胎盘剥离不全
D. 胎盘嵌顿
E. 胎盘植入

正确答案：D。胎盘嵌顿

解析：在第三产程中，由于子宫收缩药物应用不当，宫颈内口附近子宫肌出现环形收缩，使已剥离的胎盘嵌顿于宫腔，所以说子宫不协调性收缩可造成的是胎盘嵌顿（D对）。胎儿娩出后子宫纤维缩复不良，易发生胎盘滞留（P211）（A错）或产后出血。胎盘绒毛黏附于子宫肌层表面为胎盘粘连（P211）（B错）。胎盘剥离不全（P211）（C错）：第三产程过早牵拉脐带或按压子宫，影响胎盘正常剥离，胎盘已剥离部位血窦开放而出血。胎盘植入（P211）（E错）指胎盘绒毛在其附着部位与子宫肌层紧密连接。